某女，36岁。既往痛经，经行血块多，停经6个月，排除妊娠。近1周来，又见尿频、尿急、尿痛，舌质红有瘀斑，苔黄根腻，脉涩。医师诊为瘀血闭经、热淋，宜选用的药是
A. 萹蓄
B. 瞿麦
C. 通草
D. 地肤子
E. 广金钱草

正确答案：B。瞿麦

解析：本题考查的是瞿麦的主治病证。既往痛经，经行血块多，停经6个月，排除妊娠。近1周来，又见尿频、尿急、尿痛，舌质红有瘀斑，苔黄根腻，脉涩。医师诊为瘀血闭经、热淋，宜选用的药是瞿麦（B对）。瞿麦：【主治病证】（1）热淋，血淋，石淋。（2）瘀血闭经。萹蓄（A错）：【主治病证】（1）热淋涩痛。（2）蛔虫病，蛲虫病。（3）湿疹，阴痒。通草（C错）：【主治病证】（1）湿热淋证。（2）湿温证，水肿尿少。（3）产后乳汁不下。地肤子（D错）：【主治病证】（1）热淋。（2）风疹，湿疹，阴痒，湿疮。广金钱草（E错）：【主治病证】（1）石淋，热淋。（2）水肿尿少。（3）黄疸尿赤。